影响神经纤维动作电位幅度的主要因素是
A. 刺激强度
B. 刺激时间
C. 阈电位水平
D. 神经纤维直径
E. 细胞内、外的Na+浓度

正确答案：E。细胞内、外的Na+浓度